下列关于腺体瘘的叙述中，正确的说法是
A. 瘘口经常有少量的清亮唾液流出
B. 瘘口很少是混浊的唾液流出
C. 口腔内由导管口流出的唾液尚正常
D. 进食、咀嚼、嗅到或想到美味食品时，唾液的流出量显著增加
E. 以上均正确

正确答案：E。以上均正确

解析：腺体瘘：腺体区皮肤有小的点状瘘孔，其周围有瘢痕，瘘管的腺端通向一个或多个腺小叶的分泌管。从瘘口经常有少量的清亮唾液流出，很少是混浊的。进食、咀嚼、嗅到或想到美味食品时，唾液的流出量显著增加。口腔内由导管口流出的唾液尚正常。掌握“涎瘘”知识点。